具有心脏毒性，需要注射维生素E，进行抗毒的是
A. 氨氯地平
B. 顺铂
C. 紫杉醇
D. 多柔比星
E. 谷胱甘肽

正确答案：D。多柔比星

解析：本题考查多柔比星。具有心脏毒性，需要注射维生素E，进行抗毒的是多柔比星（D对）。氨氯地平（A错）不良反应主要有：低血压、面部潮红、头痛、下肢及踝部水肿、牙龈增生等。顺铂（B错）主要不良反应有：消化道反应、肾毒性、神经毒性、骨髓抑制、过敏反应等。紫杉醇（C错）主要不良反应有：过敏反应、骨髓抑制、神经毒性、心血管毒性、胃肠道反应、肝脏毒性、脱发等。谷胱甘肽（E错）的不良反应主要有：少见恶心、呕吐和头痛、罕见皮疹等。